桡侧腕屈肌
A. 起于桡尺骨的前面
B. 是前臂浅层肌中位于最桡侧的一块
C. 止于第3掌骨底的掌面
D. 止于豌豆骨
E. 可屈肘、屈腕，并使腕外展

正确答案：E。可屈肘、屈腕，并使腕外展

解析：桡侧腕屈肌起于肱骨内上髁、前臂深筋膜，而非桡尺骨的前面（A错）；是前臂浅层肌中位于第2桡侧的一块，最桡侧（B错）；止于第2掌骨底的掌面，而非第3掌骨底的掌面（C错），也非豌豆骨（D错）；可屈肘、屈腕，并使腕外展（E对）。